葡萄柚汁升高地平类药物水平属
A. 吸收的相互作用
B. 分布的相互作用
C. 代谢的相互作用
D. 排泄的相互作用
E. 消除的相互作用

正确答案：C。代谢的相互作用

解析：本题考查药物的相互作用。葡萄柚汁会影响CYP3A4代谢，同时抑制CYP3A4的活性，地平类药物是通过CYP3A4代谢的药物，与葡萄柚汁同服，会使药物的代谢减慢，生物利用度增加（C对）。